女，43岁。近1月来发热，乏力，气短。有先天性心脏病史。查体：T37.2℃，双肺呼吸音清，心率100次/分，律齐，胸骨左缘第3肋间可闻及响亮粗糙的收缩期杂音。实验室检查血WBC13.4×10⁹/L,N0.89,HbI04g/L，尿常规沉渣镜检RBC5/HP，该患者需首先考虑的诊断是
A. 急性肾小球肾炎
B. 急性心包炎
C. 风湿热
D. 感染性心内膜炎
E. 急性心肌炎

正确答案：D。感染性心内膜炎

解析：中年患者，有先天性心脏病史（感染性心内膜炎的易患因素），近来发热，乏力，气短，查体：T37.2℃（正常值为36℃～37℃），双肺呼吸音清，心率100次/分，律齐，胸骨左缘第3肋间可闻及响亮粗糙的收缩期杂音（提示室间隔缺损），实验室检查：血WBC13.4×10⁹/L（正常值为4～10×10⁹/L，提示白细胞增高），N0.89（正常值为50%～70%，提示中性粒细胞比值增高），HbI04g/L（正常值为100～300g/L），尿常规沉渣镜检RBC5/HP，根据患者的病史、临床症状及体征、实验室检查考虑最可能的诊断为感染性心内膜炎（D对），感染性心内膜炎主要表现为发热、乏力、伴有心脏杂音及周围体征，实验室检查可见白细胞增高、血尿等。急性肾小球肾炎（A错）临床特点为急性起病，表现为血尿、蛋白尿、水肿和高血压，可伴有一过性肾功能不全。急性心包炎（B错）为心包脏层和壁层的急性炎症性疾病，以胸痛、心包摩擦音、心电图改变及心包渗出后心包积液为特征。风湿热（C错）该病具有多种临床表现，可能包括关节炎、心脏炎、舞蹈病、皮下结节及边缘性红斑。心肌炎（E错）多数病人发病前1-3周有病毒感染前驱症状，如发热、全身倦怠感和肌肉酸痛，或恶心、呕吐等消化道症状，随后可以有心悸、胸痛、呼吸困难、水肿，甚至晕厥、猝死。